某渔村发现多例儿童及成人患者，均有相似的主要症状表现：脑功能障碍，步态不稳，语言不清，谵语等，当地的猫、狗也发生不明原因的发狂致死现象。当地居民以鱼、贝等海产品为主要食品。初步判断当地存在的可能致病原因是
A. HAV污染
B. 镉污染
C. 铅污染
D. 有机汞污染
E. 寄生虫污染

正确答案：D。有机汞污染

解析：本题考查有机汞污染。本题中该村居民有脑功能障碍，步态不稳，语言不清，谵语等症状，而且猫、狗也发生不明原因的发狂致死现象。初步判断当地居民经常食入被汞污染的鱼、贝等海产品，其存在的可能致病原因是有机汞污染（D对ABCE错）。